结肠癌最早出现的临床症状是
A. 腹部肿块
B. 全身症状如贫血、消瘦、低热等
C. 肠梗阻症状
D. 排便习惯和粪便性状的改变
E. 阵发性绞痛

正确答案：D。排便习惯和粪便性状的改变

解析：结肠癌早期常无特殊症状，发展后最早出现排便习惯与粪便性状的改变（D对）。腹部肿块（A错）是瘤体本身或粪块，对判断结肠癌有一定的参考价值，但不是结肠癌最早出现的症状。全身症状如贫血、消瘦、低热等（B错）多为长期慢性失血、癌肿溃烂、感染、毒素吸收等因素造成，出现较晚。肠梗阻症状（C错）一般属于结肠癌的中晚期症状，多表现为慢性低位不完全肠梗阻。阵发性绞痛（E错）属于肠梗阻表现，在中晚期出现。